腹膜为全身面积最大的浆膜，薄而光滑，呈半透明状，壁腹膜和脏腹膜相互移行围成一浆膜腔，称腹膜腔。腹膜有分泌、吸收、支持、固定、修复和防御等功能。腹膜从腹、盆壁移行于脏器或脏器间相互移行形成许多结构，主要有网膜、系膜、韧带和陷凹等。不是腹膜形成的结构
A. 大网膜
B. 肠系膜
C. 腹股沟韧带
D. 冠状韧带
E. 直肠子宫陷凹

正确答案：C。腹股沟韧带

解析：大网膜(A错)、肠系膜(B错)、冠状韧带(D错)、直肠子宫陷凹(E错)均为腹膜形成的结构，腹股沟韧带(C对)为腱膜增厚形成的结构。